男，65岁。右侧阴囊逐渐增大5年，无疼痛。查体：见右侧阴囊肿大，大小约15cm×10cm，呈囊性，未触及睾丸，透光试验阳性。首先应该考虑的诊断是
A. 睾丸炎
B. 精索静脉曲张
C. 腹股沟斜疝
D. 睾丸肿瘤
E. 睾丸鞘膜积液

正确答案：E。睾丸鞘膜积液

解析：老年男性患者，阴囊无痛性肿大5年，体查见右侧阴囊有一囊性肿块，透光试验阳性（提示鞘膜积液），未触及睾丸，结合患者病史和体查，首先应该考虑的诊断是睾丸鞘膜积液（E对）。睾丸炎（A错）主要表现为寒战、高热、睾丸疼痛，伴阴囊、大腿根部以及腹股沟区放射痛，体检可触及睾丸。精索静脉曲张（B错）主要表现为阴囊胀大、坠胀感和隐痛，步行或站立过久时加重，平卧休息后可缓解，体检可触及睾丸，透光试验阴性。腹股沟斜疝（C错）的肿大阴囊，平卧时肿块可回纳，透光试验亦呈阴性。睾丸肿瘤（D错）为实质性肿块，质地坚硬，透光试验呈阴性。